右下腹麦氏点压痛、反跳痛、肌紧张是急性阑尾炎的典型体征，其发生的主要机制是
A. 炎症致盲肠痉挛
B. 内脏神经反射
C. 炎症致阑尾痉挛
D. 阑尾腔压力增高
E. 炎症刺激壁层腹膜

正确答案：E。炎症刺激壁层腹膜

解析：麦氏点（McBurney点）指脐与右髂前上棘连线中外1/3交界处，为阑尾在体表的投影。急性阑尾炎患者通常在右下腹麦氏点出现压痛、反跳痛、肌紧张等典型体征，其主要是由于阑尾的炎性渗出刺激壁层腹膜所致（E对）。阑尾传入神经的传入脊髓节段在第10、11胸节，所以当急性阑尾炎发病开始时，常表现为脐周牵涉痛，其机制为内脏神经反射（B错）。炎症致盲肠痉挛（A错）、炎症致阑尾痉挛（C错）、阑尾腔压力增高（D错）可引起腹痛，不会引起腹部压痛、反跳痛、肌紧张等表现。